不属于苍术的主治病证是
A. 表证夹湿
B. 痰饮水肿
C. 风寒湿痹
D. 湿阻中焦
E. 脾虚乏力

正确答案：E。脾虚乏力

解析：本题考查的是苍术的主治病证。不属于苍术的主治病证是脾虚乏力（E错，为本题正确答案）。苍术：【主治病证】（1）湿阻中焦（D对）证，痰饮，水肿（B对）。（2）风寒湿痹（C对），表证夹湿（A对）。（3）湿盛脚气、痿证。（4）夜盲，眼目昏涩。脾虚乏力为刺五加的主治病证。刺五加：【主治病证】（1）脾虚乏力，食欲不振，气虚浮肿。（2）肾虚腰膝酸软，小儿行迟。（3）心悸气短，失眠多梦，健忘。（4）胸痹心痛，痹痛日久，跌打肿痛。